含有亚磺酰基苯并咪唑结构的药物是
A. 马来酸氯苯那敏
B. 盐酸雷尼替丁
C. 法莫替丁
D. 盐酸赛庚啶
E. 奥美拉唑

正确答案：E。奥美拉唑

解析：本题考查奥美拉唑。奥美拉唑（E对）含亚磺酰基苯并咪唑结构，为抗溃疡药。马来酸氯苯那敏（A错）含硝基，为H1受体拮抗剂。盐酸雷尼替丁（B错），法莫替丁（C错）均为H₂受体拮抗剂，前者含呋喃环，后者是咪噻唑的衍生物。盐酸赛庚啶（D错）含芳环结构，是H1受体拮抗剂，主要治疗过敏。